化学性污染物进入人体的主要途径是
A. 呼吸道、消化道、皮肤
B. 鼻腔、口腔、鼻窦
C. 皮肤、黏膜、结膜
D. 血液、唾液、淋巴液
E. 腮腺、淋巴腺、扁桃腺

正确答案：A。呼吸道、消化道、皮肤